24岁女性，干部，告诉医生自己在饭厅吃饭觉得菜很淡，想拿酱油，但别人先拿走了；想喝水时，有人即去倒水，认为别人了解自己的想法。该症状是
A. 嫉妒妄想
B. 罪恶妄想
C. 夸大妄想
D. 超价观念
E. 思维被洞悉

正确答案：E。思维被洞悉

解析：该患者想拿酱油、想喝水，有人就拿走了酱油、去倒水，内心所想的事情即使没有用文字书写，但是自己的想法都被别人了解即为思维被洞悉（E对）。嫉妒妄想的患者无中生有地坚信自己的配偶对自己不忠诚，另有所爱（A错）。罪恶妄想又称自罪妄想，患者无根据地坚信自己犯了严重的错误或罪恶，甚至认为自己最大恶极、死有余辜，应受严厉惩罚（B错）。夸大妄想是患者认为自己拥有非凡的才能、智慧、财富、权利、地位等（C错）。超价观念是一种具有强烈情感色彩的错误观念，其发生一般均有一定事实根据，不十分荒谬离奇，也没有明显的逻辑推理错误（D错）。